减少尿酸排泄，引起高尿酸血症的是
A. 吲哚美辛
B. 氢氯噻嗪
C. 苯溴马隆
D. 丙磺舒
E. 秋水仙碱

正确答案：B。氢氯噻嗪

解析：本题考查氢氯噻嗪的作用。减少尿酸排泄，引起高尿酸血症的是氢氯噻嗪（B对）。氢氯噻嗪的不良反应：1.电解质紊乱，表现为：①低钾血症；②低氯性碱中毒或低氯、低钾性碱中毒；③低钠血症；④脱水造成血容量和肾血流量减少亦可引起肾小球滤过率降低；⑤升高血氨；⑥高钙血症；⑦高尿酸血症；⑧血磷、镁及尿钙降低。2.升高血糖。3.升高血脂。4.性功能减退。5.噻嗪类利尿药可引起中枢神经系统（如眩晕、头痛）、胃肠道、血液系统（白细胞减少、血小板减少等）和皮肤反应（如光敏反应和皮疹）等不良反应。吲哚美辛（A错）的主要不良反应以胃肠道反应最为常见，也可致血栓形成、肝衰竭、肝坏死、哮喘等。苯溴马隆（C错）和丙磺舒（D错）都有促尿酸排泄作用。秋水仙碱（E错）的主要不良反应有胃肠道反应，中毒时出现水样腹泻及血便、脱水、休克；对肾及骨髓也有一定损害作用。